正常小儿能坐时出现的生理弯曲是
A. 骶椎后凸
B. 腰椎前凸
C. 胸椎前凸和颈椎前凸
D. 胸椎后凸
E. 颈椎前凸

正确答案：D。胸椎后凸

解析：幼儿出生时脊柱无弯曲，仅呈轻微后凸。3个月左右抬头动作的出现使颈椎前凸；6个月后能坐，出现胸椎后凸（D对）；1岁左右开始行走，出现腰椎前凸。这样的脊椎自然弯曲至6-7岁才为韧带所固定。